适用于出血较多的紧急情况，作为暂时止血的是
A. 指压止血
B. 包扎止血法
C. 填塞止血法
D. 结扎止血法
E. 药物止血法

正确答案：A。指压止血

解析：指压止血用手指压迫出血部位供应动脉的近心端，适用于出血较多的紧急情况，作为暂时止血，然后再改用其他方法作进一步止血。掌握“口腔颌面部创伤急救”知识点。